宫颈癌最常见的病理类型是
A. 鳞腺癌
B. 腺癌
C. 恶性腺癌
D. 粘液腺癌
E. 鳞状细胞癌

正确答案：E。鳞状细胞癌

解析：宫颈癌最常见的病理类型是鳞状细胞癌（E对），占子宫颈癌的75%～80%；其次是腺癌（B错），占子宫颈癌的20%～25%，主要组织学类型包括黏液腺癌（D错）和恶性腺瘤（C错）；再次是鳞腺癌（A错）占子宫颈癌3%～5%。